舍格伦综合征区别于慢性涎腺炎的病理要点是
A. 淋巴细胞浸润
B. 腺泡破坏
C. 小叶内导管增生
D. 小叶轮廓存在
E. 纤维组织增生

正确答案：D。小叶轮廓存在

解析：舍格伦综合征主要是淋巴细胞和组织细胞增生浸润。病变从小叶中心开始，初先沿腺泡之间进行，继而破坏腺泡，使其为密集淋巴细胞取代，有时可形成淋巴滤泡；腺小叶的轮廓仍保留，内无纤维组织的修复反应。小叶内导管可残留，有些导管上皮增生形成上皮岛，或扩张形成囊肿。叶间导管扩张，外形不整，导管上皮部分脱落，管周结缔组织水肿，可有炎症细胞浸润。掌握“坏死性唾液腺化生与舍格伦综合征”知识点。